A型标准血清与B型血液混合时可引起
A. 血液凝固
B. 红细胞凝集
C. 红细胞叠连
D. 红细胞收缩
E. 溶血

正确答案：B。红细胞凝集